临床上最多见的鳃裂囊肿来源于
A. 第一鳃裂
B. 第二鳃裂
C. 第三鳃裂
D. 第四鳃裂
E. 胸腺咽管

正确答案：B。第二鳃裂

解析：鳃裂囊肿的起源尚有不同观点，多数认为系由胚胎鳃裂残余组织所形成。临床上最多见的是第二鳃裂来源的鳃裂囊肿；其次为第一鳃裂来源；第三、四鳃裂来源比较少见。掌握“甲状舌管囊肿及鳃裂囊肿”知识点。